抗菌谱广、作用强且不良反应小的药物是
A. 诺氟沙星
B. 司帕沙星
C. 环丙沙星
D. 加替沙星
E. 左氧氟沙星

正确答案：E。左氧氟沙星

解析：本题考查左氧氟沙星的性质。左氧氟沙星（E对）抗菌谱广、作用强且不良反应小。诺氟沙星（A错）对未成年人骨骼形成有延缓作用，会影响到发育，故禁止未成年人服用。司帕沙星（B错）易产生光敏反应、心脏毒性和神经中枢毒性。环丙沙星（C错）对革兰氏阴性菌的抗菌活性强。加替沙星（D错）的不良反应包括高血糖、低血糖、糖尿病、糖耐量异常、高血糖昏迷、低血糖昏迷等。